呼吸频率加倍，潮气量减半时，将使
A. 每分通气量增加
B. 每分通气量减少
C. 肺泡通气量增加
D. 肺泡通气量减少
E. 肺泡通气量不变

正确答案：D。肺泡通气量减少

解析：肺泡通气量=（潮气量-无效腔气量）×呼吸频率=潮气量×呼吸频率-无效腔气量×呼吸频率。若呼吸频率加倍，潮气量减半时，因为无效腔气量不变，所以肺泡通气量减少（D对CE错）。每分通气量=潮气量×呼吸频率，因此呼吸频率加倍，潮气量减半时，每分通气量不变（AB错）。